下列对绿脓杆菌（铜绿假单胞菌）作用最强的氨基糖苷类抗生素是
A. 卡那霉素
B. 庆大霉素
C. 阿米卡星
D. 妥布霉素
E. 链霉素

正确答案：D。妥布霉素